房室束穿行的结构是
A. 左纤维三角
B. 右纤维三角
C. 瓣膜间隔
D. 室间隔膜部
E. 圆锥韧带

正确答案：B。右纤维三角

解析：右纤维三角（B对）内有房室束穿行，房室束在室间隔膜部和肌部交界处离开中心纤维体。